穿枕骨大孔入颅后又经颈静脉孔出颅的神经是
A. 迷走神经
B. 舌下神经
C. 副神经延髓根
D. 副神经脊髓根
E. 舌咽神经

正确答案：D。副神经脊髓根

解析：副神经脊髓根（D对）自脊髓前、后根之间出脊髓，在椎管内上行，经枕骨大孔入颅腔，与副神经延髓根（C错）合成副神经，副神经连同迷走神经（A错）、舌咽神经（E错）一起经颈静脉孔出颅。舌下神经（B错）经舌下神经管出颅。